在实施心血管疾病健康教育第二年，某市政府宣布，在所有副食商店不再出售肥肉，在全市范围内提倡禁烟活动属于
A. 历史性因素
B. 成熟因素
C. 观察偏倚
D. 人为因素
E. 回归因素

正确答案：A。历史性因素